根据《药品经营质量管理规范》，不符合药品批发企业进货管理要求的是
A. 签订进货合同应明确质量条款
B. 购进药品应有合法票据
C. 建立购进记录，做到票、账、货相符
D. 按规定保存购货记录
E. 每两年应对进货情况进行质量评审

正确答案：E。每两年应对进货情况进行质量评审

解析：本题考查的是药品批发企业药品采购。药品批发企业应当定期对药品采购的整体情况进行综合质量评审（E错，为本题正确答案）。药品批发企业药品采购：（1）药品采购的要求：企业的采购活动应当做到“三个确定”和“一个协议”，包括供货单位合法资格的确定、所购入药品合法性的确定、供货单位销售人员合法资格的确定以及与供货单位签订质量保证协议（A对）。（2）首营企业与首营品种的审核：对于首营企业与品种，采购部门应当填写相关申请表格，经过质量管理部门和企业质量负责人的审核批准。必要时应当组织实地考察，对供货单位质量管理体系进行评价。对首营企业的审核，应当查验加盖其公章原印章的以下资料，确认真实、有效：《药品生产许可证》或者《药品经营许可证》复印件；营业执照、税务登记、组织机构代码的证件复印件，以及上一年度企业年度报告公示情况；相关印章、随货同行单（票）样式；开户户名、开户银行及账号。采购首营品种应当审核药品的合法性，索取加盖供货单位公章原印章的药品生产或者进口批准证明文件复印件并予以审核，审核无误的方可采购。以上资料应当归入药品质量档案。（3）对销售人员的审核：企业应当核实、留存供货单位销售人员以下资料：加盖供货单位公章原印章的销售人员身份证复印件；加盖供货单位公章原印章和法定代表人印章或者签名的授权书，授权书应当载明被授权人姓名、身份证号码，以及授权销售的品种、地域、期限；供货单位及供货品种相关资料。（4）质量保证协议：企业与供货单位签订的质量保证协议至少包括以下内容：明确双方质量责任；供货单位应当提供符合规定的资料且对其真实性、有效性负责供货单位应当按照国家规定开具发票；药品质量符合药品标准等有关要求；药品包装、标签、说明书符合有关规定；药品运输的质量保证及责任；质量保证协议的有效期限。（5）票据管理：采购药品时，企业应当向供货单位索取发票（B对）。发票应当列明药品的通用名称、规格、单位、数量、单价、金额等；不能全部列明的，应当附《销售货物或者提供应税劳务清单》，并加盖供货单位发票专用章原印章、注明税票号码。发票上的购、销单位名称及金额、品名应当与付款流向及金额、品名一致，并与财务账目内容相对应。发票按有关规定保存。（6）采购记录：采购药品应当建立采购记录（CD对）。采购记录应当有药品的通用名称、剂型、规格、生产厂商、供货单位、数量、价格、购货日期等内容，采购中药材、中药饮片的还应当标明产地。（7）药品直调：除发生灾情、疫情、突发事件或者临床紧急救治等特殊情况，以及其他符合国家有关规定的情形外，企业一律不得采用直调方式（即将本企业已采购的药品不入本企业仓库，而是从供货单位直接发送到购货单位的行为）购销药品。符合开展药品直调的，企业应当建立专门的采购记录，保证有效的质量跟踪和追溯。（8）药品采购综合评审：企业应当定期对药品采购的整体情况进行综合质量评审，建立药品质量评审和供货单位质量档案，并进行动态跟踪管理。